有关同工酶概念的叙述，错误的是
A. 同工酶常由几个亚基组成
B. 不同器官的同工酶谱不同
C. 同工酶的理化性质不同
D. 同工酶催化不同的底物反应
E. 同工酶的免疫学性质不同

正确答案：D。同工酶催化不同的底物反应

解析：同工酶是指催化相同的化学反应（D错误，为本题正确答案），但酶蛋白的分子结构、理化性质乃至免疫学性质不同的一组酶（C、E选项正确），同一个体不同发育阶段和不同组织器官中，编码不同亚基的基因开放程度不同，合成的亚基种类和数量也不同，这使得某种同工酶在同一个体的不同组织中，以及同一细胞的不同亚细胞结构的分布也不同，形成不同的同工酶谱（A、B选项正确）。